男性，60岁。排尿困难3个月，体检发现前列腺变硬，为排除前列腺癌，最有价值的实验室检查是
A. 血癌胚抗原
B. 血酸性磷酸酶
C. 血甲胎球蛋白
D. 血碱性磷酸酶
E. 前列腺特异性抗原（PSA）

正确答案：E。前列腺特异性抗原（PSA）

解析：老年男性患者，排尿困难3个月，体检发现前列腺稍硬，为排除前列腺癌，最有价值的实验室检查是血清前列腺特异性抗原（PSA）检测，PSA具有前列腺组织特异性，血清PSA水平升高常提示前列腺癌的可能，因此，为排除前列腺癌，意义最大的实验室检查项目是血前列腺特异抗原（E对）。血癌胚抗原（CEA）（九版诊断学P417）（A错）多用于结直肠癌的诊断。血酸性磷酸酶（ACP）（B错）主要来源于前列腺、红细胞和血小板，其可用于前列腺癌的诊断，但不如PSA特异性高。甲胎球蛋白（AFP）（九版诊断学P416）（C错）多用于原发性肝癌的诊断。血碱性磷酸酶（ALP）（九版诊断学P363）（D错）多用于骨肉瘤及前列腺癌骨转移的诊断。